下络小肠，上连“目系”的经脉是
A. 足少阴肾经
B. 足阳明胃经
C. 足厥阴肝经
D. 手少阴心经
E. 手少阳三焦经

正确答案：D。手少阴心经

解析：本题考查的是脏腑同官窍之间的联系。下络小肠，上连“目系”的经脉是手少阴心经（D对）。脏腑同官窍之间的关系：目、耳、鼻、口、舌、前阴、后阴等官窍，都是经脉循行所经过的部位，而经脉又多入内属络于脏腑，这样，五官九窍同内脏之间，亦可通过经脉的沟通而联系起来。例如，手少阴心经属心，络小肠，上连“目系”，其别络上行于舌；足厥阴肝经（C错）属肝，络胆，上连“目系”；足阳明胃经（B错）属胃，络脾，环绕口唇等。足少阴肾经（A错）属肾，络膀胱。手少阳三焦经（E错）与脏腑官窍之间的关系，2022年考试指南未明确说明。